男，40岁。精神分裂症病史18年，第3次入院。入院后给予氟哌啶醇治疗，3天后加至30mg/d，第7天出现肌肉僵硬、震颤、吞咽困难，T39.8℃，意识不清，大汗淋漓，血清肌酸激酶增多。该患者出现的情况最可能是
A. 迟发性运动障碍
B. 急性肌张力障碍
C. 恶性综合征
D. 5-羟色胺综合征
E. 药源性帕金森综合征

正确答案：C。恶性综合征

解析：该患者18年精神分裂症病史，第3次入院。入院后给予氟哌啶醇治疗，3天后加至30mg/d（药物加量过快，用量过高），第7天出现肌肉僵硬、震颤、高热，意识不清，大汗淋漓（自主神经功能紊乱），血清肌酸激酶增多，故最可能是恶性综合症（C对）。抗精神病药物不良反应：1.椎体外系反应：①急性肌张力障碍呈现不由自主的、奇特的表现，包括眼上翻、斜颈、颈后倾、面部怪相和扭曲、吐舌、张口困难、角弓反张和脊柱侧弯等（B错）；②静坐不能；③类帕金森症最为常见。治疗的最初1～2个月发生，发生率可高达56%。表现可归纳为：运动不能、肌张力高、震颤和自主神经功能紊乱（E错）；4.迟发性障碍是以不自主的、有节律的刻板式运动为特征（A错）。